去甲肾上腺素可使血管收缩，主要是激动以下哪种受体所致
A. α1
B. α2
C. β1
D. β2
E. α3

正确答案：A。α1

解析：去甲肾上腺素激动血管的α1受体，使血管收缩，主要是使小动脉和小静脉收缩。其中皮肤黏膜血管收缩最明显，其次是肾脏血管。掌握“去甲肾上腺素”知识点。